男，38岁，劳累后心悸、气短5年，近一周间断咯血，无发热。查体:双颊紫红，口唇轻度发绀，颈静脉怒张。两肺未闻干、湿啰音。心浊音界在胸骨左缘第3肋间向左扩大，心尖部局限性舒张期隆隆样杂音，第一心音亢进。肝脏不肿大，下肢无水肿。本病诊断应首先考虑
A. 肺结核
B. 风心病二尖瓣狭窄
C. 室间隔
D. 扩张型心肌病
E. 风心病二尖瓣关闭不全

正确答案：B。风心病二尖瓣狭窄

解析：根据病人典型二尖瓣面容及心脏听诊，可诊断为风心病二尖瓣狭窄。掌握“二尖瓣狭窄”知识点。